患者，男性，45岁。右下6可见大面积银汞充填，远中食物嵌塞，温度测试无活力。若此牙需要桩冠修复。则最不可能利用的根管是
A. 近中颊根管
B. 远中根管
C. 远中舌根管
D. 以上都是
E. 以上都不是

正确答案：C。远中舌根管

解析：本题考查桩核冠的临床注意事项及下颌第一磨牙的根管特点。患者男，右下6可见大面积银汞充填（牙体缺损），远中食物嵌塞，温度测试无活力（死髓牙或已治疗）。若此牙需要桩冠修复。则最不可能利用的根管是远中舌根管（C错，为本题正确答案）。远中舌根管细小弯曲，不符合桩核冠的应用条件。下颌第一磨牙近中颊根管（A错）与远中根管（B错）均比远中舌根管大，可能利用进行桩冠修复。